将完全埋伏或行将萌出的下颌第三磨牙移植于下颌第一磨牙处，这种方式属于
A. 自体牙移植术
B. 异体牙移植术
C. 即刻再植
D. 延期再植
E. 牙种植术

正确答案：A。自体牙移植术

解析：自体牙移植术，是将自身牙根未发育完成的牙完整地摘出，移植于自身其他的缺牙部位。目前应用最多的是，将完全埋伏或行将萌出的下颌第三磨牙移植于下颌第一磨牙处。因正畸需要拔除的前磨牙，也可用于移植。阻生尖牙及上颌第三磨牙的移植适应证很少。掌握“牙槽外科”知识点。